青霉素类最严重的不良反应为
A. 药疹
B. 荨麻疹
C. 电解质紊乱
D. 过敏性休克
E. 症状加剧现象

正确答案：D。过敏性休克

解析：变态反应：为青霉素类最常见的不良反应，在各种药物中居首位，以皮肤过敏（荨麻疹、药疹等）和血清病样反应较多见。最严重的是过敏性休克。掌握“青霉素及头孢菌素类药”知识点。